腹股沟斜疝患者疝还纳后，使肿物不再出现的压迫部位是
A. 海氏三角
B. 腹股沟韧带中点
C. 阴囊根部
D. 斜疝外环
E. 腹股沟韧带中点上方1.5cm

正确答案：E。腹股沟韧带中点上方1.5cm

解析：疝囊经腹股沟管深环突出，向内向下向前，经过腹股沟管，再穿出腹股沟管浅环，并可进入阴囊，称腹股沟斜疝，因此若压迫腹股沟管深环，则疝内容物不能经此途径疝出，而深环的体表投影点即位于腹股沟中点上方2cm，题中1.5cm也正确（E对）。海氏三角或直疝三角是腹股沟直疝的突出部位（A错）。斜疝外环也称皮下环，压迫此环，疝内容物仍可经深环突出至腹股沟管（D错）。